确定药物寒热温凉的依据是
A. 神农氏尝百草的体会
B. 《素问》："寒者热之，热者寒之"
C. 《本经》："疗寒以热药，疗热以寒药"
D. 药物作用于人体的反应
E. 口尝的滋味

正确答案：D。药物作用于人体的反应

解析：药性的寒热温凉是由药物作用于人体所产生的不同反应和所获得的不同疗效而总结出来的（D对AE错）。《素问·至真要大论》云：“寒者热之，热者寒之。”《神农本草经》序例云：“疗寒以热药，疗热以寒药。”指出了寒凉药用治阳热证，温热药用冶阴寒证（BC错）。